治疗高血压伴心率过快，应首选
A. α‐受体阻滞剂
B. β‐受体阻滞剂
C. 钙拮抗剂
D. 利尿剂
E. 血管紧张素转化酶抑制剂

正确答案：B。β‐受体阻滞剂

解析：Β-受体阻滞剂通过肾素释放的抑制、神经递质释放的减少、心排血量减少等达到降低血压的目的，1、2级高血压患者比较适用，尤其是心率加快的中青年患者（B对）。α-受体阻滞剂一般不作为高血压的首选药，适用于高血压伴前列腺增生等患者，也用于难治性高血压的治疗（A错）。钙拮抗剂可用于中、重度高血压的治疗，适用于单纯性收缩压增高的老年病患（C错）。利尿剂用于轻、中度高血压，适用于老年人单纯性收缩压升高的高血压及心力衰竭伴高血压的治疗（D错）。血管紧张素转化酶抑制剂可用于各种类型，各种程度的高血压，对伴有心力衰竭、左心室肥大、心肌梗死后、糖耐量降低及糖尿病肾病等合并症尤为适宜（E错）。